治疗支气管哮喘气道炎症的药物不包括
A. 糖皮质激素
B. LT调节剂
C. 曲尼司特
D. 抗胆碱药
E. 氯雷他定

正确答案：D。抗胆碱药

解析：治疗支气管哮喘气道炎症的药物主要有糖皮质激素（A对）、LT调节剂（B对）、酮替芬和新一代组胺H₁受体拮抗剂如阿司咪唑、曲尼司特（C对）、氯雷他定（E对）。抗胆碱药（D错，为本题正确选项）为缓解哮喘发作类药物，属于支气管舒张药，主要作用为通过阻断节后迷走神经通路，降低迷走神经张力而起到舒张支气管、减少黏液分泌的作用。